弥散性血管内凝血早期发病过程的中心环节是
A. 凝血因子Ⅻ的激活
B. 组织凝血因子入血
C. 凝血酶产生增加，血液凝固性增高
D. 纤溶酶原激活物的形成
E. 纤维蛋白降解

正确答案：C。凝血酶产生增加，血液凝固性增高

解析：凝血酶产生增加，血液凝固性增高（C对），微循环中形成大量微血栓是弥散性血管内凝血早期即高凝期发病过程的中心环节。凝血因子Ⅻ的激活（A错）是内源性系统的激活。组织凝血因子入血（B错）是外源性系统的激活。纤溶酶原激活物的形成（D错）和纤维蛋白降解（E错）出现在继发性纤溶亢进期，即弥散性血管内凝血晚期。